正胜邪退则疾病趋向
A. 恶化
B. 相持
C. 好转
D. 痊愈
E. 死亡

正确答案：C、D。好转；痊愈

解析：本题考查的是邪正盛衰与疾病的转归。正胜邪退则疾病趋向好转（C对）与痊愈（D对）。邪盛则正衰，疾病趋向恶化，甚至导致死亡。邪正盛衰的病机，是指在疾病过程中，机体的抗病能力与致病邪气之间相互斗争中所发生的盛衰变化。在疾病的发展过程中，邪正的消长盛衰变化决定病机、病证的虚实夹杂或转化。一般规律是，正盛邪退则病势好转或向愈，邪去正虚则病愈而体虚，正虚邪恋则病势缠绵迁延而难愈，邪盛正衰则病势恶化（A错），甚则死亡（E错）。